湿热壅滞型腹痛宜选方
A. 大承气汤
B. 玉女煎
C. 龙胆泻肝汤
D. 大黄黄连泻心汤
E. 泻青丸

正确答案：A。大承气汤

解析：湿热壅滞型腹痛，其机理为湿热内结、气机阻滞、腑气不通，治疗应以通腑泄热、行气导滞为法，方用软坚润燥、通腑泄热、荡涤肠胃的大承气汤（A对）。玉女煎，其功用为清胃滋阴，可用于中消之胃热炽盛证（B错）。龙胆泻肝汤功能清泻肝胆实火，清理肝胆湿热，无泄热通腑之功（C错）。大黄黄连泻心汤主治心下痞，按之濡，其脉关上浮者（D错）。泻青丸功用为清肝泻火（E错）。